关于牙的说法，正确的是
A. 分乳牙、恒牙和智牙
B. 主要由牙骨质构成
C. 每个牙均有牙冠、牙颈和牙根
D. 牙的表面均被覆釉质
E. 牙周膜包括牙周组织、牙槽骨和牙龈三部分

正确答案：C。每个牙均有牙冠、牙颈和牙根

解析：牙分为乳牙及恒牙，智牙为恒牙中的第3磨牙(A错)，牙主要由牙质构成(B错)，每个牙均有牙冠、牙颈和牙根(C对)，牙冠外覆有釉质，牙颈及牙根外有牙骨质(D错)，牙周膜为组织膜，主要由胶原纤维束组成，而牙周组织包括牙周膜、牙槽骨和牙龈三部分(E错)。